下列杂质中，属于一般杂质的有
A. 氯化物
B. 硫酸盐
C. 铁盐
D. 砷盐
E. 重金属

正确答案：A、B、C、D、E。氯化物；硫酸盐；铁盐；砷盐；重金属

解析：本题考查杂质。一般杂质是指在自然界中分布较广泛、在多种药品的生产和贮藏过程中容易引入的杂质，如酸、碱、水分、氯化物（A对）、硫酸盐（B对）、铁盐（C对）、砷盐（D对）、重金属（E对）等，其检查方法收载于《中国药典》通用技术要求中，具有普遍性，原料需要检查一般杂质。